耻骨
A. 构成髋骨后下部
B. 分耻骨体和耻骨支两部分
C. 耻骨体构成髋臼的大部分
D. 耻骨结节位于耻骨梳与耻骨嵴之间
E. 无

正确答案：D。耻骨结节位于耻骨梳与耻骨嵴之间

解析：耻骨构成髋骨前下部（A错），分体和上、下二支（B错）。体组成髋臼前下 1/5（C错）。耻骨结节位于耻骨梳与耻骨嵴之间（D对）。